某男，42岁。阳事不举，精薄清冷；伴神疲倦怠，形寒肢冷，面色无华，头晕耳鸣，腰膝酸软，小便清长。诊断为阳痿，证属肾阳不足。可选用的中成药有
A. 强龙益肾胶囊
B. 益肾灵颗粒
C. 疏肝益阳胶囊
D. 黄精赞育胶囊
E. 海龙蛤蚧囗服液

正确答案：A、B、E。强龙益肾胶囊；益肾灵颗粒；海龙蛤蚧囗服液

解析：本题考查阳痿之肝郁不舒证的常用中成药。结合患者症状判断为阳痿之肝郁不舒证，宜选用的中成药有：强龙益肾胶囊（A对）、益肾灵颗粒（B对）、海龙蛤蚧囗服液（E对）。阳痿之肝郁不舒证【症状】阳事不兴，或举而不坚；伴心情抑郁，胸胁胀满，善太息。舌苔薄白，脉弦。【中成药应用】益肾灵颗粒、强龙益肾胶囊、蚕蛾公补片、海龙蛤蚧口服液、健阳片。疏肝益阳胶囊（C错）具有疏肝解郁、活血补肾的功效，对肝郁肾虚兼血瘀证的阳痿患者最适宜。男性不育症之湿热下注证【症状】阳事不兴或勃起不坚，精子少或死精较多；伴小腹急满，小便短赤。舌苔薄黄，脉弦滑。
【中成药应用】黄精赞育胶囊（D错）。